下颌44，46，47，48，35，36缺失，余留牙均正常的患者适合做
A. 固定义齿
B. 可摘局部义齿
C. 覆盖可摘局部义齿
D. 活动桥
E. 即刻可摘局部义齿

正确答案：B。可摘局部义齿

解析：可摘局部义齿适应证（适用范围较广）适用于各种牙列缺损，尤其是游离端缺失者。掌握“局部义齿类型，肯氏分类及模型观测”知识点。